女，40岁。烧伤1小时。查体：T37.5℃.P131次／分，R27次／分，BP82/53mmHg。双侧臀部、双侧大小腿及足部皮肤烧伤，创面无水泡，呈蜡白色，痛觉消失。体重60kg。该患者第一个24小时补液理论上应是
A. 血浆1380ml，平衡盐溶液2760ml，5%葡萄糖溶液2000ml
B. 全血1380ml，平衡盐溶液2760ml，5%葡萄糖溶液2000ml
C. 血浆2000ml，平衡盐溶液3000ml，5%葡萄糖溶液1500ml
D. 血浆2000ml，平衡盐溶液2000ml，5%葡萄糖溶液1500ml
E. 血浆2760ml，平衡盐溶液1380ml，5%碳酸氢钠溶液2000ml

正确答案：A。血浆1380ml，平衡盐溶液2760ml，5%葡萄糖溶液2000ml

解析：女性患者烧伤一小时，根据中国新九分法，患者烧伤总面积=6%（双臀）+21%（双大腿）+13%（双小腿）+6%（双足）=46%，患者创面无水泡，呈蜡白色，痛觉消失，为Ⅲ度烧伤，根据烧伤面积和烧伤程度属于特重烧伤，此刻患者生命体征：T37.5℃.P131次／分，R27次／分，BP82/53mmHg（心率、呼吸加快，血压明显下降），提示烧伤休克，根据患者烧伤面积、严重程度及临床表现，此时补液应遵循广泛深度烧伤补液公式：胶体：晶体为1：2，所以补充胶体即血浆46×60×1.5×1/3=1380ml，晶体液2760ml。基础水份5%葡萄糖溶液2000ml。答案选择A。